中成药血脂康中含有的化学成分是
A. 洛伐他汀
B. 辛伐他汀
C. 阿托伐他汀钙
D. 依折麦布
E. 非诺贝特

正确答案：A。洛伐他汀

解析：本题考查调血脂药。血脂康每粒胶囊中含洛伐他汀（A对）2.5mg，以及不饱和脂肪酸等成分。中成药血脂康中不含辛伐他汀（B错）、阿托伐他汀钙（C错）、依折麦布（D错）、非诺贝特（E错）等化学成分。